气质指的是人的典型的、稳定的心理特征，主要表现为
A. 个人心理活动过程的速度和稳定性
B. 心理活动的指向性（倾向于外部事物或倾向于内部体验）
C. 心理过程的强度、心理活动的指向性（倾向于外部事物或倾向于内部体验）
D. 个人心理活动过程的速度和稳定性、心理过程的强度
E. 个人心理活动过程的速度和稳定性、心理过程的强度、心理活动的指向性（倾向于外部事物或倾向于内部体验）

正确答案：E。个人心理活动过程的速度和稳定性、心理过程的强度、心理活动的指向性（倾向于外部事物或倾向于内部体验）